关于难治性肾病综合征的治疗，不予考虑的药物是
A. 甲泼尼龙（甲基强的松龙）
B. 环孢素A
C. 环磷酰胺
D. 硫唑嘌呤
E. 氟尿嘧啶（5-FU）

正确答案：E。氟尿嘧啶（5-FU）

解析：难治性肾病综合症是指在足量糖皮质激素治疗8～12周以上病情仍未缓解的肾病综合征，其治疗可采用：①更换等剂量甲泼尼龙（A对）口服或静脉滴注；②加用细胞毒药物，如环磷酰胺（C对）、苯丁酸氮芥、硫唑嘌呤（D对），三者可选其一，首选环磷酰胺；③若糖皮质激素和细胞毒药物均无效，则可选用免疫抑制剂环孢素（B对）。氟尿嘧啶（E错，为本题正确答案）为抗癌药，主要用于消化道肿瘤的治疗，不能用于肾病综合征的治疗。